非特异性感觉投射的生理特点正确的是
A. 不通过脑干网状结构上行激动系统起作用
B. 与大脑皮层具有点对点的投射关系
C. 没有专一的感觉传导功能
D. 为单突触传递系统
E. 不易受巴比妥类药物的影响

正确答案：C。没有专一的感觉传导功能

解析：非特异性感觉投射系统的主要功能是维持和改变大脑皮层的兴奋状态，换言之，它具有上行唤醒作用，没有专一的感觉传导功能（C对）。非特异投射系统是指丘脑非特异投射核及其投射至大脑皮层的神经通路。该系统经多次换元弥散性投射到大脑皮层的广泛区域，因而不是单突触传递系统（D错），与皮层不具有点对点的投射关系（B错）。非特异性感觉投射系统通过脑干网状结构（A错），间接接受来自感觉传导道第二级神经元侧支的纤维投射。巴比妥类药物通过阻断网状结构中大多数神经元上行和下行纤维的递质谷氨酸而发挥作用，所以非特异投射系统易受巴比妥类药物的影响（E错）。